环境质量评价方法的基本要素中哪项是环境质量评价的基础的是
A. 评价参数
B. 评价标准
C. 监测数据
D. 评价权重
E. 环境质量评价模型

正确答案：C。监测数据

解析：本题考查环境质量评价的基础。环境质量的评价方法一般需具备监测数据、评价参数、评价标准、权重以及评价模式等。其中监测数据（B对ACDE错）是环境质量评价的基础。要取得准确、足够而有代表性的监测数据，必须通过周密的计划和布点对环境要素中有代表性的监测指标进行监测。